慢性肾盂肾炎大体描述正确的是
A. 肾弥漫性颗粒状
B. 肾肿大、苍白
C. 肾表面散在出血点
D. 肾不对称性缩小
E. 肾弥漫性肿大

正确答案：D。肾不对称性缩小

解析：慢性肾盂肾炎X线静脉肾盂造影检查显示肾脏不对称性缩小，伴不规则瘢痕和肾盂、肾盏的变形（D对）。肾弥漫性颗粒状（A错）是慢性硬化性肾小球肾炎的肾脏表现，即继发性颗粒性固缩肾。肾肿大、苍白（B错）是膜性肾小球病的肾脏表现。肾表面散在出血点（C错）、肾弥漫性肿大（E错），是急性弥漫性肾小球肾炎的肾脏表现。